停经3个月，下腹胀痛，伴中等量阴道流血1天，子宫大小如50天，宫口松，容1指，宫内似有组织可触及
A. 流产感染
B. 稽留流产
C. 先兆流产
D. 难免流产
E. 不全流产

正确答案：E。不全流产

解析：不全流产时，因妊娠组织物的排出，子宫就是小于妊娠月份的，这是不全流产的一个特点。不全流产：常发生于较晚期妊娠（10周以后），胎盘正在发育或已形成，流产时胎儿及部分胎盘排出，整个胎盘或部分胎盘仍附在子宫壁上，子宫不能很好收缩，以致阴道流血甚多。残留的胎盘日久可形成胎盘息肉，反复出血，且易诱发感染。掌握“自然流产”知识点。